人与环境之间不断进行着最本质的联系是
A. 吸入氧气呼出二氧化碳
B. 吸收与排泄
C. 信息传递
D. 物质交换和能量转移
E. 营养物质的转换

正确答案：D。物质交换和能量转移

解析：本题考查人与环境之间的联系。人与环境之间不断进行着最本质的联系是物质交换和能量转移（D对ABCE错）。物质交换指的是人们与环境之间的物质相互影响，包括空气、水、土壤、植物和动物等，如人们从环境中摄取物质，如吸入氧气呼出二氧化碳，然后将这些物质进行转化，如吸收和排泄，最后将转化后的物质释放到环境中，促进环境的更新。能量转移指的是人们从环境中获取能量，如阳光和热量，并将其转化为可以使用的能量，如热能和电能，然后将其释放到环境中，促进环境的更新。